男性，55岁。巩膜皮肤黄染进行性加重2月余，胆囊肿大呈圆形，可推动，无触压痛，首先考虑的疾病是
A. 胆囊癌
B. 急性胆囊炎
C. 胆囊结石
D. 急性病毒性肝炎
E. 胰头癌

正确答案：E。胰头癌

解析：中年男性患者，进行性黄疸2月余，胆囊肿大，可推动，无触压痛（Courvoisier阳性），首先考虑的疾病是胰头癌（E对）。胰头癌浸润或压迫胆总管可导致胆汁下行受阻，胆汁淤积引起黄疸及胆囊肿大；由于胰头癌所致的胆道梗阻一般无胆道感染，故胆囊多无触、压痛。胆囊癌（P452）（A错）多数无黄疸，仅部分肝十二指肠韧带处淋巴结转移或肝外胆管受阻塞的晚期胆囊癌患者可出现黄疸。急性胆囊炎（P443）（B错）主要表现为高脂饮食后出现右上腹阵发性绞痛，多伴有恶心、呕吐等消化道症状，可有轻度黄疸，胆囊触压痛明显。胆囊结石（P439）（C错）主要表现为高脂饮食后出现右上腹阵发性绞痛，可有恶心、呕吐，极少引起黄疸。急性病毒性肝炎（D错）起病急骤，常有畏寒、发热、乏力、食欲差、恶心、呕吐等症状，有或无黄疸，胆囊无肿大。